患儿3岁，失聪失语，反应迟钝，意识不清，动作不由自主，时时口流痰涎，喉间痰鸣，关节僵硬，肌肉软弱，间或有癫痫发作，舌体胖，可见瘀斑，苔腻，脉滑。治疗应首选
A. 加味六味地黄丸
B. 调元散
C. 虎潜丸
D. 调元散合二陈汤
E. 通窍活血汤合二陈汤

正确答案：E。通窍活血汤合二陈汤

解析：该题考查五迟、五软的辩证以及方药。五迟、五软是小儿生长发育障碍的病症。五迟指立迟、行迟、齿迟、发迟、语迟;五软指头项软、口软、手软、足软、肌肉软。本该患儿3岁，失聪失语，反应迟钝，意识不清，动作不由自主，时时口流痰涎，喉间痰 鸣，关节僵硬，肌肉软弱，问或有癫痫发作，舌体胖，可见瘀斑，苔腻，脉滑。可判断为五迟五软痰瘀阻滞，治法涤痰开窍，活血通络。 主方通窍活血汤合二陈汤（E对）。加味六味地黄丸治疗肝肾亏损（A错）。调元散治疗心脾两虚（B错）。虎潜丸滋阴降火，强壮筋骨。治疗肝肾不足，阴虚内热之痿证。（C错）。调元散合二陈汤治疗痰瘀阻滞（D错）。